有关淋巴管的描述，正确的是
A. 是均匀一致的管道
B. 均与血管伴行
C. 数目多于动脉,但少于静脉
D. 管内有大量瓣膜
E. 遍布全身各器官

正确答案：D。管内有大量瓣膜

解析：由于相邻两瓣膜间淋巴管扩张，所以淋巴管外观呈串珠状或藕节装，并非均匀一致的管道（A错）。淋巴管大部分与血管伴行，并非全部（B错）。淋巴管内有大量瓣膜（D对）防止淋巴逆流。淋巴管并非遍布全身各器官，上皮、角膜、晶状体、软骨、胎盘、脊髓等处无淋巴管（E错）。